预防结核用
A. 隐性或显性感染
B. 通过胎盘获得母体的抗体
C. 接种疫苗
D. 注射抗毒素
E. 注射类毒素

正确答案：C。接种疫苗